某地居民长期以玉米为主食，经常有人出现食欲下降、体重减轻、记忆力减退、消化不良、易腹泻、手背及足背皮肤有对称性皮炎等症状。这可能是因为缺乏哪种营养素所致
A. 维生素C
B. 叶酸
C. 尼克酸
D. 维生素D
E. 视黄醇

正确答案：C。尼克酸